重度妊娠期高血压疾病的产科处理，下述哪项是错误的
A. 孕27周，经治疗病情好转而稳定，可继续妊娠
B. 孕32周，积极治疗24～48小时症状改善，估计胎儿可成活，可继续妊娠
C. 孕33周，经积极治疗24～48小时病情继续恶化，应继续积极治疗至病情稳定后终止妊娠
D. 子痫患者应积极治疗，控制抽搐2小时后可考虑终止妊娠
E. 病情继续恶化应行剖宫术

正确答案：C。孕33周，经积极治疗24～48小时病情继续恶化，应继续积极治疗至病情稳定后终止妊娠

解析：重度子痫前期患者：妊娠＜26周经治疗病情不稳定者建议终止妊娠；妊娠26～28周根据母胎情况及当地母儿诊治能力决定是否期待治疗；妊娠28～34周，如病情不稳定，经积极治疗24～48小时病情仍加重，促胎肺成熟后终止妊娠；如病情稳定，可考虑期待治疗，并建议转至具备早产儿救治能力的医疗机构；妊娠≥34周患者，胎儿成熟后可考虑终止妊娠；妊娠37周后的重度子痫前期应终止妊娠。掌握“娠期高血压疾病”知识点。